患者，男，36岁。5天前发热、咽痛，应用抗生素治疗无效，颈部浅表淋巴结肿大，咽部充血。扁桃体Ⅱ肿大，下肢少许瘀斑。化验：血红蛋白80g/L，白细胞16.0×10⁹L，血小板34×10⁹L，骨髓象：原始细胞占0.6。为明确诊断应做的检查是
A. 血小板抗体
B. 血清铁蛋白
C. 骨髓扫描
D. 骨髓涂片细胞学检查
E. 淋巴结活检

正确答案：D。骨髓涂片细胞学检查

解析：患者，男，36岁。5天前发热、咽痛，应用抗生素治疗无效（排出细菌感染的因素），颈部浅表淋巴结肿大，咽部充血。扁桃体Ⅱ肿大，下肢少许瘀斑（说明有出血表现）。化验：血红蛋白80g/L（男性正常范围：120 ～160g/L），白细胞16.0×10⁹L（正常范围：4～10×10⁹/L），血小板34×10⁹L（正常范围：100～300×10⁹L），骨髓象：原始细胞占0.6（原始细胞比例超过30%，通常被认为是急性白血病的主要诊断标准）。该病人发病急，有发热、贫血、出血的表现，血中白细胞明显增多，原始细胞比例显著增加，应考虑为急性白血病（P571）。为明确诊断应做的检查是骨髓涂片细胞学检查（D对），骨髓涂片是判断有核细胞增生程度，骨髓增生程度根据成熟红细胞与有核细胞之比可将骨髓增生程度分为5个等级：增生极度活跃、增生明显活跃、增生活跃、增生减低、增生极度减低。急性白血病的骨髓增生程度为增生极度活跃。血小板抗体（A错）主要用于诊断特发性血小板减少性紫癜。血清铁蛋白（B错）作为判断是否缺铁或铁负荷过量的指标。骨髓扫描（C错）主要用于辅助诊断骨髓的增生或减退性疾病。淋巴结活检（E错）可以协助诊断导致淋巴结肿大的有关疾病，淋巴结肿大超过3周不能查明原因或怀疑有肿瘤性淋巴结肿大时才进行活检。